诊断侵蚀性葡萄胎的依据，正确的是
A. 不发生脑转移
B. 前次妊娠为早产
C. 清宫后半年内发病
D. 能査到卵巢黄素囊肿
E. 光镜下见不到绒毛结构

正确答案：C。清宫后半年内发病

解析：前次妊娠为早产（B错）只继发绒癌，而侵蚀性葡萄胎只由葡萄胎妊娠继发形成。妊娠滋养细胞肿瘤主要经血行播散，转移发生早而且广泛，可发生肺、阴道、盆腔、肝和脑转移（A错），但不能区分侵蚀性葡萄胎和绒癌。组织病理学检查时，在子宫肌层内或子宫外转移灶组织中若见到绒毛或退化的绒毛阴影，则诊断为侵蚀性葡萄胎；若仅见成片滋养细胞浸润及坏死出血，未见绒毛结构者，则诊断为绒癌（E错）。根据七版妇产科学观点，继发于葡萄胎清宫后半年内发病者多为侵蚀性葡萄胎（C对），一年以上者多为绒癌。大量hCG刺激卵巢卵泡内膜细胞发生黄素化形成卵巢黄素囊肿，故只要存在大量hCG的持续作用，如葡萄胎、侵蚀性葡萄胎、绒癌，都能查到卵巢黄素化囊肿（D错），无特异性，不是诊断依据。